对照组罹患率/试验组罹患率
A. 发病率
B. 相对危险度
C. 效果指数
D. 保护率
E. 都不是

正确答案：C。效果指数

解析：本题考查效果指数。对照组罹患率/试验组罹患率＝效果指数（C对ABDE错）。